药用部位为干燥花粉的药材是
A. 辛夷
B. 菊花
C. 丁香
D. 蒲黄
E. 款冬花

正确答案：D。蒲黄

解析：本题考查的是花类中药的药用部位。药用部位为干燥花粉的药材是蒲黄（D对）。药用部位为完整的花、花序或花的某一部分，这类中药称花类中药。完整的花有的是已开放的，如洋金花、红花；有的是尚未开放的花蕾，如丁香（C错）、金银花。药用花序亦有的是采收未开放的，如款冬花（E错）；有的要采收已开放的，如菊花（B错）、旋覆花。而夏枯草实际上采收的是带花的果穗。药用仅为花的某一部分，如西红花系柱头，莲须系雄蕊，玉米须系花柱，松花粉、蒲黄等则为花粉粒等。辛夷（A错）：【来源】为木兰科植物望春花、玉兰或武当玉兰的干燥花蕾。